以下哪种传染病不可能是恢复期携带者
A. 伤寒
B. 霍乱
C. 乙肝
D. 白喉

正确答案：D。白喉

解析：本题考查恢复期病原携带者的概念。恢复期病原携带者是指临床症状消失后仍能在一定时间内向外排出病原体的人，如乙型肝炎（C对）、伤寒（A对）、霍乱（B对）等。白喉（D错，为本题正确答案）多见于潜伏期病原携带者。